患者，男，45岁。上腹隐痛，便潜血阳性，钡餐见胃窦小弯侧黏膜纹理紊乱，胃壁僵硬首先考虑
A. 慢性胃炎
B. 胃溃疡
C. 胃癌
D. 胃淋巴肉瘤
E. 萎缩性胃炎

正确答案：C。胃癌

解析：胃癌常发生于40～70岁人群，男性居多（患者为男性，45岁）。中晚期胃癌有上腹压痛（患者体征为上腹隐痛）；癌肿出血时粪便隐血试验阳性、黑粪、或呕血（患者检查示便潜血阳性）；钡餐见胃窦小弯侧黏膜纹理紊乱，胃壁僵硬，诊断为中晚期胃癌浸润型（C对）。浅表性胃炎常以胃窦部最为明显，多为弥漫性胃黏膜表面黏液增多，有灰白色或黄白色渗出物，病变处黏膜红白相间或花斑状，似麻疹样改变，有时有糜烂。慢性萎缩性胃炎的黏膜多呈苍白或灰白色，亦可呈红白相间，白区凹陷；皱襞变细或平坦，由于黏膜变薄可透见呈紫蓝色的黏膜下血管；病变可弥漫或主要在胃窦部，如伴有增生性改变者，黏膜表面颗粒状或结节状（A错）。胃溃疡X线钡餐检查可见龛影及黏膜皱襞集中等直接征象，单纯痉挛、激惹现象等间接征象。症状：早期无明显症状，常在肿瘤增大时才出现症状，与胃溃疡及胃癌症状相似，有上腹痛、恶心、呕吐、厌食、饱胀感、体重减轻等。由于肿瘤溃疡形，大部分病例有胃出血，表现为呕血和柏油样便。体征：肿瘤变大时在上腹部可触及包块，淋巴肉瘤可摸到肿大的淋巴结。部分患者有继发肿瘤，应注意检查。胃淋巴瘤的特征性表现为胃粘膜表面多发的不规则结节性改变，X线见多数圆形不规则充盈缺损，称为“鹅卵石样”改变（D错）。萎缩性胃炎的临床表现：①胃脘部胀满；胃脘部疼痛；烧心及消化不良症状；大便异常及虚弱症状；贫血。胃黏膜颜色变淡。②黏膜下血管透见。③黏膜皱襞细小甚至消失。④当萎缩性胃炎伴有腺体颈部过度增生或肠上皮化生时，黏膜表面粗糙不平，呈颗粒状或结节状，有时可见假息肉形成，而黏膜下血管显露的特征常被掩盖。⑤萎缩黏膜脆性增加，易出血，并可有糜烂灶。⑥萎缩性胃炎可同时伴有慢性浅表性胃炎的表现，如充血红斑、附着黏液，以及反光增强等。病理检查：①胃黏膜内固有的腺体萎缩；②化生；③增生；④癌变。